缘上回位于大脑的
A. 额叶
B. 颞叶
C. 顶叶
D. 岛叶
E. 无

正确答案：C。顶叶

解析：缘上回位于大脑的岛叶（C对）。